对急性肾炎诊断和鉴别诊断最有价值的血液化验是
A. 血沉增快
B. 白细胞总数增高
C. 4～8周内总补体及C3下降
D. 轻度贫血
E. 抗链球菌溶血素"O"增高ASO

正确答案：C。4～8周内总补体及C3下降

解析：对急性肾炎诊断和鉴别诊断最有价值的血液化验是4～8周内总补体及C3下降（C对）。白细胞计数可增高或正常与血沉增快在发生炎症时出现，不是特异性指标（AB错）。急性和慢性肾小球肾炎患者，大多数没有贫血，急进性肾小球肾炎的患者可以出现轻中度的贫血（D错）。扁桃体炎、咽炎、猩红热、风湿性关节炎活动期出现链球菌溶血素"O"增高（E错）。